义齿初戴时，需要选磨调（牙合）的原因，除了
A. 任何（牙合）架与患者实际情况均不完全符合
B. 义齿制作过程中操作有误
C. 人工牙牙尖形态不够标准
D. 制作时使用了简单（牙合）架
E. 取颌位关系时通常垂直距离预先定高一些

正确答案：E。取颌位关系时通常垂直距离预先定高一些

解析：本题考查选磨调（牙合）的原因。无牙颌患者的牙槽嵴会有一定程度的吸收，为了恢复面下1/3的合适距离，在取颌位关系时通常垂直距离预先定高一些（E错，为本题的正确答案），以补偿牙槽骨的吸收，也利于排牙，并不是为了选磨调（牙合）。当出现任何（牙合）架与患者实际情况均不完全符合（A对）或义齿制作过程中操作有误（B对）时，需要进行必要的选磨调（牙合），使义齿与患者符合。人工牙牙尖形态不够标准（C对），会影响咬合，使义齿不稳定，也需要进行必要的选磨调（牙合）。使用简单（牙合）架（D对）不能很准确的将颌位关系转移，会导致义齿咬合的偏差，也需要进行必要的选磨调（牙合）。